患者，男，34岁，有冶游史。胸壁腹壁广泛多发皮疹1月，轻度瘙痒，无疼痛，梅毒螺旋体检查和梅毒血清试验阳性。应首先考虑的诊断是
A. 一期梅毒
B. 二期梅毒
C. 三期梅毒
D. 隐性梅毒
E. 先天性梅毒

正确答案：B。二期梅毒

解析：患者，男，34岁有冶游史，易感染梅毒，胸壁腹壁广泛多发皮疹1月，轻度瘙痒，无疼痛，梅毒螺旋体检查和梅毒血清试验阳性，诊断为二期梅毒（B对）。一期梅毒：①有不洁性交史。②潜伏期3周左右③有硬性下疳和无痛横痃。④实验室检查：在硬下疳处取材，用暗视野显微镜下可查到螺旋体；梅毒血清学试验初期为阴性，后逐渐转为阳性（A错）。三期梅毒：①有不洁性交、早期梅毒病史。②典型症状为结节性梅毒疹、树胶肿及心血管、神经系统损害。③梅毒血清学试验阳性及脑脊液检查可确诊（C错）。隐性梅毒：有梅毒感染史，但无临床表现或临床表现已消失，梅毒血清学试验阳性，脑脊液检查正常（D错）。先天性梅毒：①其母患梅毒。②有典型的早期或晚期梅毒症状。③梅毒血清学试验阳性（E错）。